男，24岁。发作性呼吸困难2年，曾肺功能检查诊断：“支气管哮喘”，控制使用吸入糖皮质激素+长效β₂受体激动剂，2天来症状加重，连续吸入短效β₂受体激动剂效果欠佳。此时患者应首先采取的措施是
A. 口服抗生素
B. 再次吸入糖皮质激素+长效β₂受体激动剂
C. 继续吸入短效β₂受体激动剂
D. 口服糖皮质激素
E. 口服氨茶碱

正确答案：D。口服糖皮质激素

解析：青年男性患者，患有支气管哮喘，控制病情使用吸入糖皮质激素＋长效β₂受体激动剂（属于慢性哮喘长期治疗方案中的3级），2天来症状加重，连续吸入短效β₂受体激动剂效果不佳，所以应调整到4级，首先选择采用白三烯调节剂（选项中没有此选项），或者口服糖皮质激素（常用于吸入激素无效或需要短期加强治疗的患者）（D对），控制症状。口服抗生素（A错）多用于哮喘合并感染的情况。患者为控制病情使用吸入糖皮质激素＋长效β₂受体激动剂，但病情加重，再次吸入糖皮质激素+长效β₂受体激动剂（B错）并不能控制病情，应选用口服激素。短效β₂受体激动剂（C错）能有效缓解支气管痉挛，为急性哮喘发作的首选用药。口服氨茶碱类药物（E错）用于轻～中度哮喘急性发作以及哮喘的维持治疗，口服缓释茶碱尤适用于夜间哮喘症状的控制，不作为首选。